提供社区卫生服务的骨干力量是
A. 临床医生
B. 内科医生
C. 外科医生
D. 心理医生
E. 全科医生

正确答案：E。全科医生